胸导管经过膈的何结构
A. 冠状窦口
B. 腰肋三角
C. 腔静脉孔
D. 主动脉裂孔
E. 无

正确答案：D。主动脉裂孔

解析：胸导管经过膈的主动脉裂孔（D对）。